适用于热敏物料和低熔点物料的粉碎设备是
A. 球磨机
B. 胶体磨
C. 冲击式粉碎机
D. 气流式粉碎机
E. 液压式粉碎机

正确答案：D。气流式粉碎机

解析：本题考查粉碎设备的选择。适用于热敏物料和低熔点物料的粉碎设备是气流式粉碎机（D对）。气流粉碎机通过将气源部份的普通空气变更为氮气、二氧化碳气等惰性气体，可使本机成为惰性气体保护设备，适用于易燃易爆、易氧化等物料的粉碎分级加工。